生长成活后，柔软而富有弹性，特别适合于面部植皮的为
A. 表层皮片
B. 薄中厚皮片
C. 厚中薄皮片
D. 全厚皮片
E. 带真皮下血管网的全厚皮片

正确答案：D。全厚皮片

解析：游离皮片移植适用于大面积的浅层组织，包括皮肤和粘膜的缺损。一般说来，面颈部植皮应多采用全厚或厚中厚皮片。掌握“皮片移植”知识点。